女，1岁。发热伴咳喘3天，口周稍青紫。用鼻前庭导管吸氧，氧流量应为
A. 0.5～1L/分
B. 1.5～2L/分
C. 2.5～3L/分
D. 3.5～4L/分
E. 4.5～5L/分

正确答案：A。0.5～1L/分

解析：用鼻前庭导管吸氧，氧流量应为0.5—1L/分（A对）。氧流量不能太大，太大会使呼吸中枢产生适应现象，不利于自主呼吸。